脊髓的静脉注入
A. 硬膜外腔的椎内静脉丛
B. 奇静脉
C. 半奇静脉和奇静脉
D. 腰静脉
E. 髂内静脉

正确答案：A。硬膜外腔的椎内静脉丛

解析：脊髓的静脉通过前、后根静脉注入硬膜外腔的椎内静脉丛（A对），后者可再注入腰静脉（D错）。奇静脉（BC错）收集右侧肋间静脉、食管静脉、支气管静脉和半奇静脉的血液。半奇静脉（C错）收集左侧下部肋间后静脉、食管静脉和副半奇静脉的血液。髂内静脉（E错）盆壁和盆腔脏器的血液。